治疗高血压肾阳虚衰证，应首选
A. 济生肾气丸
B. 半夏白术天麻汤
C. 六味地黄丸
D. 当归参附汤合右归丸
E. 当归四逆汤合苏合香丸

正确答案：A。济生肾气丸

解析：高血压肾阳虚衰证，治宜温补肾阳，首选补肾助阳，化生肾气的济生肾气丸（A对）。半夏白术天麻汤功用化痰息风，健脾祛湿，主治风痰上扰证，为高血压痰湿内阻证的代表方（B错）。六味地黄丸填精滋阴补肾，主治肾阴精不足证（C错）。当归参附汤合右归丸功用益气壮阳，温经止痛，适用于治疗心绞痛心肾阳虚证（D错）。当归四逆汤温经散寒，养血通脉，主治血虚寒厥证；苏合香丸温通开窍，行气止痛，主治寒闭证（E错）。